患者，65岁。皮肤、巩膜黄染呈进行性加重，大便持续变白，病后消痩明显。应首先考虑的是
A. 急性病毒性肝炎
B. 肝硬化
C. 肝癌
D. 胰头癌
E. 胆总管结石

正确答案：D。胰头癌

解析：本例患者有消瘦，皮肤、巩膜黄染等黄疸表现，且呈进行性加重，大便持续变白，故诊断首先考虑的是胰头癌（D对）。急性病毒性肝炎（A错）主要表现为食欲减退、腹胀、部分患者可出现皮肤或巩膜黄染、肝区疼痛，但不会有白陶土样粪便。肝硬化（B错）患者主要表现为肝功能减退如黄疸、出血、贫血和门静脉高压如腹水、食管胃底静脉曲张。肝癌（C错）主要表现为肝区疼痛、肝脏呈进行性增大，质地坚硬，表面凹凸不平，常有大小不等的结节。胆总管结石（E错）主要表现为Charcot三联征，即腹痛（发生于剑突下或右上腹，呈阵发性发作）、寒战高热、黄疸（呈现间歇性和波动性，而非持续进行性加重）。